基本母核为莨菪烷类的生物碱有
A. 山莨菪碱
B. 氧化苦参碱
C. 阿托品
D. 樟柳碱
E. 长春花碱

正确答案：A、C、D。山莨菪碱；阿托品；樟柳碱

解析：本题考查的是莨菪烷类生物碱的组成。基本母核为莨菪烷类的生物碱有山莨菪碱（A对）、阿托品（C对）与樟柳碱（D对）。洋金花主要化学成分为莨菪烷类生物碱，由莨菪醇类和芳香族有机酸结合生成的一元酯类化合物。主要有莨菪碱（阿托品）、山莨菪碱、东莨菪碱、樟柳碱和N-去甲莨菪碱。《中国药典》以东莨菪碱为指标成分进行含量测定，要求东莨菪碱不得少于0.15%。氧化苦参碱（B错）为苦参的主要化学成分，属于吡啶类生物碱。苦参所含主要生物碱是苦参碱和氧化苦参碱，《中国药典》以其为指标成分进行鉴别和含量测定，含量测定要求苦参碱和氧化苦参碱总量不得少于1.2%。此外苦参碱还含有羟基苦参碱、N-甲基金雀花碱、安那吉碱、巴普叶碱和去氢苦参碱（苦参烯碱）等。这些生物碱都属于双稠哌啶类，具喹喏里西啶的基本结构，除N-甲基金雀花碱外，均由两个哌啶环共用一个氮原子稠合而成。分子中均有两个氮原子，一个是叔胺氮，一个是酰胺氮。长春花碱（E错）属于吲哚类生物碱。长春花中具有抗癌作用的长春碱和长春新碱均属于双吲哚类，是由两分子单吲哚类生物碱聚合而成的衍生物。